下列药物容易通过胎盘而影响胎儿的是
A. 所有激素类药物
B. 分子量大的药物
C. 极性药物
D. 血浆蛋白结合率低的药物
E. 脂溶性低的药物

正确答案：D。血浆蛋白结合率低的药物

解析：分子量小（B错）、脂溶性高（E错）、血浆蛋白结合率低（D对）、非极性（C错）的药物容易通过胎盘而影响胎儿。并非所有激素都容易通过胎盘（A错），如泼尼松不易通过胎盘屏障到达胎儿。